疱在上皮的棘层内或在基底层之上，有棘层松解，为以下哪种病理表现
A. 基层下疱
B. 棘层松解
C. 角化不良
D. 异常增生
E. 棘层内疱

正确答案：E。棘层内疱

解析：棘层内疱：疱在上皮的棘层内或在基底层之上，有棘层松解，上皮细胞失去黏附力而彼此分离。见于天疱疮，也见于病毒性水疱。掌握“口腔黏膜基本病理变化”知识点。